脾胃虚弱泄泻宜选用的方药是
A. 保和丸加减
B. 四神丸加减
C. 参苓白术散加减
D. 加味左金丸加减
E. 舒肝丸加减

正确答案：C。参苓白术散加减

解析：本题考查的是泄泻的辨证论治。脾胃虚弱泄泻宜选用的方药是参苓白术散加减（C对）。泄泻脾胃虚弱证：【方剂应用】基础方剂为参苓白术散（莲子肉、薏苡仁、砂仁、桔梗、白扁豆、白茯苓、人参、甘草、白术、山药）加减。保和丸加减（A错）为泄泻食滞肠胃证的方剂应用。泄泻食滞肠胃证：【方剂应用】基础方剂为保和丸（神曲、山楂、茯苓、半夏、莱菔子、陈皮、连翘、麦芽）加减。四神丸加减（B错）为泄泻肾阳虚衰证的方剂应用。泄泻肾阳虚衰证：【方剂应用】基础方剂为四神丸（补骨脂、五味子、肉豆蔻、吴茱萸）加减。方剂应用为加味左金丸加减（D错）或舒肝丸加减（E错）的病证，2022年考试指南未明确说明。